属于肾素抑制剂的药品是
A. 依那普利
B. 替米沙坦
C. 哌唑嗪
D. 坦洛新（坦索罗辛）
E. 阿利克仑（阿利吉仑）

正确答案：E。阿利克仑（阿利吉仑）

解析：本题考查肾素抑制剂。阿利克仑（E对）为肾素抑制剂，可直接降低血浆中肾素活性。依那普利（A错）为血管紧张素转换酶抑制剂。替米沙坦（B错）为血管紧张素Ⅱ受体阻断剂。哌唑嗪（C错）属于α受体阻滞剂,是二线降压药。坦洛新（D错）主要用于治疗前列腺增生而致的异常排尿症状,适用于轻、中度患者及未导致严重排尿障碍者。